与血浆凝固酶阴性葡萄球菌无关的疾病是
A. 食物中毒
B. 败血症
C. 股骨头置换术后感染
D. 急性膀胱炎
E. 细菌性心内膜炎

正确答案：A。食物中毒

解析：过去认为凝固酶阴性葡萄球菌（CNS）对人不致病，现已证明其已成为医源性感染的常见重要病原菌。CNS引起感染有：1.泌尿系统感染，如年轻妇女急性膀胱炎（D对）、尿道感染；2.细菌性心内膜炎（E对）；3.败血症（B对）；4.术后及植入医用器械引起的感染，如植入医用器械如心脏起搏器安装、置换人工心瓣膜、长期腹膜透析导管感染、人工关节感染（C对）、静脉滴注及脑脊液分流术等。引起食物中毒（A错，为本题正确答案）的葡萄球菌为金黄色葡萄球菌，凝固酶是其致病物质之一。